患者，女，46岁。风湿性心脏病史8年，二尖瓣狭窄，心功能Ⅰ级。口内有右下侧切牙、右下第一磨牙、左下侧切牙及左下第一磨牙残根，Ⅱ~Ⅲ度松动，需要拔除。该患者拔牙，在有菌血症发生时，有可能导致以下哪种严重并发症的风险
A. 干槽症
B. 颊间隙感染
C. 口腔上颌窦瘘
D. 颏下间隙感染
E. 亚急性感染性心内膜炎

正确答案：E。亚急性感染性心内膜炎

解析：心血管瓣膜受损类疾病是常见的心脏病，口腔是一种污染的手术环境，并且所要拔除的患牙周围通常有慢性感染存在，拔牙操作可能使细菌进入血液循环，引起一过性的菌血症。风湿性心脏病患者是细菌性心内膜炎的易感人群。掌握“牙拔除的适应证与禁忌证”知识点。